主要研究作为人所应该具备的品德、品格等，探讨什么是道德上的完人，并且从行为者的内在特质、动机，而非义务或功利的概念来评价人们行为的道德价值的是伦理学基本理论中的
A. 美德论
B. 义务论
C. 阶级论
D. 规范论
E. 效果论

正确答案：A。美德论

解析：美德论又称德性论或品德伦，其主要研究作为人所应该具备的品德、品格等。探讨了什么是道德上的“完人”，亦道德完人所具备的品质，以及告诉人们如何成为道德上的完人。美德论从行为者的内在特质、动机，而非义务或功利上的概念来评价人们行为的道德价值，其目的在于描述在一定文化或社会之中受到推崇或敬重的品格类型。掌握“伦理学”知识点。